患者，女，26岁。因左下颌角区渐进性膨隆5个月余就诊。专科检查面部不对称，触诊有乒乓球样感觉。临床初步诊断为左下颌骨牙源性角化囊性瘤。其治疗方案一般是
A. 行下颌骨部分切除，钛板修复
B. 行下颌骨部分切除，髂骨修复
C. 行下颌骨部分切除，腓骨修复
D. 仅行下颌骨部分切除
E. 手术刮除，骨创烧灼或冷冻处理

正确答案：E。手术刮除，骨创烧灼或冷冻处理

解析：由于下颌骨牙源性角化囊性瘤没有浸润生长的生物学特性，所以在手术去除囊肿时，不需要同时进行下颌骨部分切除，只需要将囊肿彻底刮出，同时为防止复发，辅以化学腐蚀剂局部涂抹或加用低温治疗。掌握“牙源性角化囊性瘤”知识点。